在流感药物预防中，WHO推荐各国储备的抗病毒药物需覆盖全国人口的
A. 0.05
B. 0.1
C. 0.15
D. 0.2
E. 0.25

正确答案：D。0.2

解析：本题考查药物预防的相关内容。在流感药物预防中，WHO推荐各国储备的抗病毒药物需覆盖全国人口的20%（D对ABCE错）。